关于T3和T4，下列哪项叙述是正确的
A. T3的血浆蛋白结合率高于T4
B. T3起效快，作用强
C. T3起效慢，作用持久
D. T3起效快，作用持久
E. T3起效慢，作用弱

正确答案：B。T3起效快，作用强

解析：T3、T4口服易吸收，两者血浆蛋白结合律均在99%以上。但T3的蛋白亲和力低于T4，游离量可为T4的10倍。T3作用强而快，维持时间短；T4作用弱而慢，维持时间长。故此题选择B项掌握“硫脲类药物”知识点。